对肥厚型梗阻性心肌病的诊断最有意义的是
A. 心电图出现深而不宽的病理性Q波
B. 胸骨左缘第三四肋间有响亮的收缩期杂音
C. 用力后心前区闷痛及晕厥史
D. 超声心动图发现舒张期室间隔与左室后壁厚度之比＞1.3
E. 可闻第三心音及第四心音

正确答案：D。超声心动图发现舒张期室间隔与左室后壁厚度之比＞1.3

解析：超声心电图是临床诊断肥厚型梗阻性心肌病最主要的手段。特征性表现为心室不对称肥厚而无心室腔增大，且舒张期室间隔与左室后壁厚度之比＞1.3（D对）。心电图出现深而不宽的病理性Q波（A错）可见于心肌梗死等患者；胸骨左缘第三四肋间有响亮的收缩期杂音（B错）可见于先天性室间隔缺损（P273）；用力后心前区闷痛及晕厥史（C错）可见于主动脉瓣狭窄（P295）；可闻第三心音及第四心音（E错）能出现于扩张型心肌病（P262），这四种症状或体征虽然都能出现在肥厚型梗阻性心肌病患者，但都不具有诊断特异性。